猪苓汤的药物组成有
A. 猪苓、茯苓、桂枝、苍术、泽泻
B. 茯苓、猪苓、桂枝、泽泻、白术
C. 猪苓、茯苓、泽泻、滑石、甘草
D. 猪苓、茯苓、泽泻、阿胶、滑石
E. 茯苓、泽泻、甘草、大枣、桂枝

正确答案：D。猪苓、茯苓、泽泻、阿胶、滑石

解析：猪苓汤用猪茯苓，泽泻滑石阿胶并，小便不利兼烦渴，利水养阴热亦平（D对）。猪苓汤的功用为利水渗湿，养阴清热，主治水热互结伤阴证。发热，口渴欲饮，小便不利，或心烦不寐，或咳嗽，或呕恶，或下利，舌红苔白或微黄，脉细数。亦治热淋，血淋等。